既能祛风湿，又能消骨鲠的药物是
A. 威灵仙
B. 防己
C. 狗脊
D. 独活
E. 木瓜

正确答案：A。威灵仙

解析：该题考查威灵仙的功效。威灵仙味辛、咸，性温，归膀胱经，其功效为祛风湿，通络止痛，消骨鲠（A对）。